典型的三叉神经痛不包括
A. 阵发性剧痛
B. 扳机点
C. 痛性抽搐
D. 夜间发作多见
E. 病程可为周期性发作

正确答案：D。夜间发作多见

解析：本题考查三叉神经痛的临床表现。三叉神经痛发作多在白天（D错，为本题的正确答案），主要表现是在三叉神经分支区域内，骤然发生闪电样剧烈疼痛，疼痛性质为电击、针刺、刀割样阵发性剧痛（A对）。疼痛可自发，也可由轻微刺激扳机点所引起，扳机点（B对）是指在三叉神经分支区域内某个固定的局限的小块皮肤或黏膜特别敏感，对此点稍加碰触，立即引起疼痛发作。发作时常常伴有颜面表情肌的痛性抽搐（C对），口角被牵向患侧。病程可为周期性发作（E对），春季及冬季容易发病。